以下哪种唾液腺肿瘤常浸润神经
A. 腺样囊性癌
B. Warthin瘤
C. 多形性腺瘤
D. 淋巴乳头状囊腺瘤
E. 腺淋巴瘤

正确答案：A。腺样囊性癌

解析：本题考查腺样囊性癌的生物学行为。腺样囊性癌（A对）常浸润神经。腺样囊性癌又称为圆柱瘤。约占唾液腺恶性肿瘤的27%。